承担职业病诊断的某医疗卫生机构违反规定，超出资质认可范围从事职业病诊断，应承担以下法律责任，除了
A. 给予警告
B. 没收违法所得
C. 罚款
D. 赔偿损失
E. 取消其相应的资格

正确答案：D。赔偿损失